挫折与心理冲突
A. 环境性应激源
B. 心理性应激源
C. 社会性应激源
D. 职业性应激源
E. 生活性应激源

正确答案：B。心理性应激源

解析：心理性应激源：如挫折与心理冲突。挫折是由于各种障碍造成动机行为而不能达到目的或趋向目标的进程受阻而延搁时产生的紧张状态和情绪反应。心理冲突包括双趋冲突、双避冲突、趋避冲突和多重趋避冲突。掌握“心理应激”知识点。